关于空气离子化的论述，哪一项是错误的
A. 空气分子受到外界强烈理化因子作用而生成正、负离子
B. 轻离子是空气离子吸附10～15个中性分子而形成的
C. 轻离子与空气中水滴、悬浮颗粒物相结合形成重离子
D. 轻负离子在一定浓度下，有很好的生理功能，如镇静、提高注意力、降压等
E. 正离子和负离子作用一致

正确答案：E。正离子和负离子作用一致

解析：本题考查空气离子化。空气离子化是指空气分子受到外界强烈理化因子作用而生成正、负离子的过程（A对）。轻离子是空气离子吸附10～15个中性分子而形成的（B对）。轻离子与空气中的水滴、悬浮颗粒物结合形成重离子（C对）。轻负离子在一定浓度下，有很好的生理功能，如镇静、提高注意力、降压等（D对）。正离子和负离子的作用是相反的（E错，为本题正确答案），正离子会使空气中的气体变得更清新，而负离子会使空气中的气体污染变得更严重。